某女大学生，19岁，病前有强迫性人格特征，在一次动物实验中，因抓大白鼠的方法不对而被鼠咬，引起焦虑和恐惧发作。而后表现为见鼠就惊叫、害怕、心跳剧烈，发展到有人谈到鼠也出现焦虑、紧张、出汗症状。病人主动求医，要求治疗。对这位病人心理评估的最佳方法是
A. 调查法
B. 观察法
C. 会谈法
D. 作品分析法
E. 心理测验法

正确答案：B。观察法